口服卡马西平的癫痫患者同时口服避孕药可能会造成避孕失败，其原因是
A. 联合用药易导致用药者对避孕药产生耐受性
B. 联合用药导致避孕药首过消除发生改变
C. 卡马西平和避孕药互相竞争血浆蛋白结合部位
D. 卡马西平为肝药酶诱导药，加快避孕药的代谢
E. 卡马西平为肝药酶抑制药，减慢避孕药的代谢

正确答案：D。卡马西平为肝药酶诱导药，加快避孕药的代谢

解析：本题考查酶的诱导与抑制。口服卡马西平的癫痫患者同时口服避孕药可能会造成避孕失败，其原因是卡马西平为肝药酶诱导药，加快避孕药的代谢（D对）。卡马西平具有肝药酶诱导作用，能够加快其他药物的代谢。